临床最常用的根管消毒方法为
A. 激光治疗
B. 微波治疗
C. 高频治疗
D. 电解治疗
E. 药物消毒

正确答案：E。药物消毒

解析：本题考查根管消毒。临床上用的根管消毒的方法包括：激光、微波、超声和药物消毒等，其中药物消毒（E对）的方法最为常用。相对于激光（A错）、微波（B错）、超声等消毒方法，药物消毒具有操作简便，效果较好，无需特殊设备和操作，患者可接受，因而临床应用广泛。